26岁孕妇，停经48日后出现阴道少量流血伴右下腹隐痛。今晨起床时突然右下腹剧痛来院。检查：BP90/60mmHg，面色苍白，下腹稍膨隆，右下腹压痛明显，肌紧张不明显，叩诊移动性浊音（±）妇科检查：子宫稍大稍软，右附件区触及有压痛包块。恰当诊断应是
A. 急性肠胃炎
B. 急性阑尾炎
C. 右侧卵巢肿瘤蒂扭转
D. 输卵管妊娠流产
E. 急性输卵管炎

正确答案：D。输卵管妊娠流产

解析：本题干主要考的是输卵管妊娠的诊断，根据停经史、阴道少量出血伴下腹痛、休克表现，腹叩诊移动性浊音（±），首先考虑输卵管妊娠流产。掌握“异位妊娠”知识点。